30岁妇女，第一胎，妊娠34周，妊娠期高血压，3小时前突然腹痛，阴道出血，色鲜红，如月经量。体检：血压70/40mmHg，宫底在剑突下2指，子宫硬，肌壁松弛不完全，胎位不清，胎心音消失。宫颈管未消失，宫颈口未开，最恰当的处理是
A. 立即扩张宫口，破膜，催产素静脉滴注引产
B. 立即人工破膜，等待自然分娩
C. 以抗休克为主，因死胎，不急于引产
D. 抗休克，尽快剖宫产
E. 立即作B型超声检查

正确答案：D。抗休克，尽快剖宫产

解析：虽然胎心消失但是没有确定胎儿以死，所以应尽快剖宫产。妊娠期高血压，3小时前突然腹痛，阴道出血，子宫硬，肌壁松弛不完全，胎位不清，胎心音消失。病情重，胎儿严重缺氧，需要手术立即结束妊娠。掌握“娠期高血压疾病”知识点。